环境流行病学研究时，不宜采用与发病同时甚至以后的环境资料来进行两者关系的研究，因为
A. 环境因素繁多复杂
B. 有潜伏期
C. 效应不特异
D. 观察指标不灵敏
E. 监测仪器不够精密

正确答案：B。有潜伏期

解析：本题考查环境流行病学研究。环境流行病学研究是环境因素与疾病发生之间关系的研究，而疾病的发生可能伴有一段潜伏期（B对ACDE错），即从接触病原体到出现症状中间可能存在一段时间。因此，环境流行病学研究时，不宜采用与发病同时甚至以后的环境资料来进行两者关系的研究，而是应该采用与发病前的环境资料来进行研究，以更好地发现潜伏期内的疾病发病机制。